再矿化疗法适合于下列哪种龋损的治疗
A. 形成碟形的中龋
B. 龋损达到牙本质浅层
C. 牙釉质早期脱矿
D. 牙本质龋
E. 牙颈部中龋

正确答案：C。牙釉质早期脱矿

解析：本题考查龋病的治疗原则与非手术治疗方法。再矿化疗法适合于牙釉质早期脱矿（C对），是采用人工方法使脱矿的釉质或牙骨质再次矿化。